消费者和经营者发生消费者权益争议的解决方式不包括
A. 协商和解
B. 向有关行政部门申请行政裁决
C. 请求消费者协会组织调解
D. 向人民法院提起诉讼

正确答案：B。向有关行政部门申请行政裁决

解析：本题考查消费者和经营者争议的解决。消费者和经营者发生消费者权益争议的解决方式不包括向有关行政部门申请行政裁决（B错，为本题正确答案）。《中华人民共和国消费者权益保护法》第六章争议的解决第三十九条：消费者和经营者发生消费者权益争议的，可以通过下列途径解决：（一）与经营者协商和解（A对）；（二）请求消费者协会或者依法成立的其他调解组织调解（C对）；（三）向有关行政部门投诉；（四）根据与经营者达成的仲裁协议提请仲裁机构仲裁；（五）向人民法院提起诉讼（D对）。